牙槽突骨折后用牙弓夹板、金属丝等方法固定后，注意应至少跨过骨折线几个正常牙位
A. 2个
B. 3个
C. 4个
D. 5个
E. 6个

正确答案：B。3个

解析：治疗应在局麻下将牙槽突及牙复位到正常解剖位置，与对颌建立正常的咬合关系，然后选用两侧稳固的邻牙作固位体，用牙弓夹板、金属丝和正畸托槽方丝弓等方法固定。注意应至少跨过骨折线3个正常牙位，才能使固定稳固可靠。掌握“牙槽突骨折、颌骨骨折”知识点。